在明确变应原后，防治Ⅰ型超敏反应的首选方法是
A. 脱敏疗法
B. 药物治疗
C. 避免接触变应原
D. 观察不予处理
E. 给予抗生素

正确答案：C。避免接触变应原

解析：在明确变应原后，防治Ⅰ型超敏反应的首选方法是避免接触变应原。掌握“概述及Ⅰ型超敏反应”知识点。